患者下列义务中应该经其知情同意后才能合理履行的是
A. 如实提供病情信息
B. 尊重医务人员的劳动
C. 避免将疾病传播给他人
D. 遵守住院规章制度
E. 支持医学生实习和发展医学

正确答案：E。支持医学生实习和发展医学

解析：患者的义务中经其知情同意后才能合理履行的是支持医学生实习和发展医学，因为患者有配合诊疗的义务（E对）。如实提供病情信息、尊重医务人员的劳动、避免将疾病传播给他人、遵守住院规章制度属于患者在医疗活动中的义务（ABCD错）。